地西泮的药理作用是
A. 抗老年痴呆
B. 抗焦虑
C. 抗抑郁
D. 抗精神失常
E. 抗帕金森病

正确答案：B。抗焦虑

解析：地西泮的作用特点：抗焦虑作用选择性强，主要用于焦虑（B对）、失眠、惊厥、癫痫、恐惧症、麻醉前给药等。